外科病人最易发生水钠代谢紊乱是
A. 原发性缺水
B. 低渗性缺水
C. 等渗性缺水
D. 高渗性缺水
E. 水过多

正确答案：C。等渗性缺水

解析：外科病人最易发生的水和钠代谢紊乱是等渗性缺水（C对）。相较内科病人而言，外科病人发生的水、钠代谢紊乱多为急性疾病（消化液急性丢失、烧伤、肠梗阻等）引发的急性缺水，即等渗性缺水。而低渗性缺水（B错）又称慢性缺水或继发性缺水，最常见于胃肠道消化液持续性丢失、大创面的慢性渗液、应用排钠利尿剂而未注意补充钠盐、等渗性缺水治疗时补充水分过多；高渗性缺水（D错）又称原发性缺水（A错），主要见于食管癌等水分摄入不足疾病，大量出汗或排尿时也会出现。水过多（E错）在临床上较少发生，主要见于抗利尿激素分泌过多、肾功能不全、过多的静脉补液等情况。